进行底物水平磷酸化的反应是
A. 葡萄糖→6-磷酸葡萄糖
B. 6-磷酸果糖→1，6-二磷酸果糖
C. 3-磷酸甘油醛→1，3-二磷酸甘油酸
D. 琥珀酰CoA→琥珀酸
E. 丙酮酸→乙酰CoA

正确答案：D。琥珀酰CoA→琥珀酸